男性，55岁。有长期饮酒史，近期患者出现严重的记忆力障碍，遗忘、错构、虚构和定向力障碍，此为
A. Werinick脑病
B. 柯萨科夫综合征
C. 精神发育迟滞
D. 老年性痴呆
E. Ganser综合征

正确答案：B。柯萨科夫综合征

解析：该中年男性患者有长期饮酒史，主要表现严重的记忆力障碍，遗忘、错构、虚构和定向力障碍为柯萨科夫综合征（遗忘综合症）（B对）。精神发育迟滞是一组在中枢神经系统发育成熟（18岁）以前起病，以智能低下和社会适应困难为临床特征（C错）的精神障碍。阿尔茨海默病（AD）是一组病因未明的原发性退行性脑变性疾病。多起病于老年期，潜隐起病，病程缓慢且不可逆，临床上以智能损害为主（D错）。刚塞综合症（Ganser）又称为心因性假性痴呆，表现为对简单问题给予近似而错误的回答，往往给人以故意或开玩笑的感觉（E错）。